下列药品销售行为中，违法的有
A. 药店经批准在边远城乡集市贸易市场内出售维C银翘片
B. 大型超市设柜台销售甲类非处方药
C. 药品生产企业在交易会上现货出售非处方药
D. 药品零售企业直接向个人消费者提供互联网药品交易服务
E. 处方药不采用开架自选方式销售

正确答案：B、C、D。大型超市设柜台销售甲类非处方药；药品生产企业在交易会上现货出售非处方药；药品零售企业直接向个人消费者提供互联网药品交易服务

解析：本题考查药品销售管理。普通商业企业不得销售处方药和甲类非处方药（B错，为本题正确答案）。《药品流通监督管理办法》第十五条规定，药品生产、经营企业不得以展示会、博览会、交易会、订货会、产品宣传会等方式现货销售药品（C错，为本题正确答案）。向个人消费者提供互联网药品交易服务的企业只能在网上销售本企业经营的非处方药，不得向其他企业或者医疗机构销售药品（D错，为本题正确答案）。